下列各项中，不属医务人员必须遵守的卫生行业纪律的是
A. 不准实行药品、仪器检查、化验检查及其他医学检查等开单提成办法
B. 不准设立小金库
C. 不准接受患者及其亲友的“红包”、物品和宴请
D. 不准通过介绍病人到其他单位检查、治疗或购买药品、医疗器械等收取回扣或提成
E. 不准外出会诊

正确答案：E。不准外出会诊

解析：实行药品、仪器检查、化验检查及其他医学检查等开单提成办法；设立小金库；接受患者及其亲友的“红包”、物品和宴请；通过介绍病人到其他单位检查、治疗或购买药品、医疗器械等收取回扣或提成等，属于医生利用职务之便，索取或非法收受患者财务或牟取其他不正当利益的违法行为，故不准实行药品、仪器检查、化验检查及其他医学检查等开单提成办法（A对）、不准设立小金库（B对）、不准接受患者及其亲友的“红包”、物品和宴请（C对）、不准通过介绍病人到其他单位检查、治疗或购买药品、医疗器械等收取回扣或提成（D对）属于医务人员必须遵守的卫生行业纪律。而医师可以外出会诊，故不准外出会诊不属医务人员必须遵守的卫生行业纪律（E错，为本题正确答案）。